男，16岁。在田地劳动时，右足被刺伤，其中混杂有异物，泥土，没有处理。随后出现面部肌肉痉挛，怕光怕声。患者致病的主要原因是
A. 异物混杂
B. 年龄小
C. 没有及时清洗
D. 伤口环境缺氧
E. 没有包扎伤口

正确答案：D。伤口环境缺氧

解析：该患者右足被刺伤，其中混杂有异物、泥土，没有处理。随后出现面部肌肉痉挛，怕光怕声，应诊断为破伤风感染发作。但破伤风发病率只占污染者（异物混杂（A错）、没有及时清洗（C错））的1％～2％，提示发病必须具有其他因素，主要因素就是缺氧环境（D对）。在缺氧环境中，破伤风梭菌（专性厌氧）的芽孢发育为增殖体，迅速繁殖并产生大量外毒素，主要是痉挛毒素，导致病人一系列临床症状和体征。其它选项只要是能够接触氧，都不会引起破伤风的发作（ABCE错）。此题容易误选C选项，需注意早期彻底清创是预防破伤风发生的重要措施，但致病的主要原因还是提供了致病菌需要的厌氧环境。